下列关于良性肿瘤特点的叙述，不正确的是
A. 可发生于任何年龄
B. 生长缓慢，多呈膨胀性生长
C. 有包膜，不侵犯周围组织
D. 细胞分化良好
E. 永远都不会威胁到生命

正确答案：E。永远都不会威胁到生命

解析：良性肿瘤对机体的影响：一般对机体无影响，如生长在要害部位或发生并发症时，也可危及生命。掌握“口腔颌面部肿瘤的概念、临床表现、诊断”知识点。